下列导致胎儿生长受限因素最常见的是
A. 妊娠期高血压疾病
B. 羊水过多
C. 多次刮宫导致宫腔粘连
D. 妊娠期糖尿病
E. 合并卵巢小囊肿

正确答案：A。妊娠期高血压疾病

解析：导致胎儿生长受限的病因包括：母体因素、胎儿因素、胎盘因素、脐带因素，其中最常见的是妊娠并发症和合并症，如妊娠高血压疾病（A对）。羊水过多（B错）、多次刮宫导致宫腔粘连（C错）、妊娠期糖尿病（D错）、合并卵巢小囊肿（E错）均可导致胎儿生长受限，但不是主要因素。